既滋肾补肝，又清虚热的药是
A. 黄精
B. 秦艽
C. 地骨皮
D. 女贞子
E. 枸杞子

正确答案：D。女贞子

解析：本题考查的是女贞子的功效。既滋肾补肝，又清虚热的药是女贞子（D对）。女贞子：【功效】滋肾补肝，清虚热，明目乌发。黄精（A错）：【功效】滋阴润肺，补脾益气。秦艽（B错）：【功效】祛风湿，舒筋络，清虚热，利湿退黄。地骨皮（C错）：【功效】退虚热，凉血，清肺降火，生津。枸杞子（E错）：【功效】滋补肝肾，明目，润肺。